使用过量氯丙嗪的精神病患者，如使用肾上腺素后，主要表现为
A. 升压
B. 降压
C. 血压不变
D. 心率减慢
E. 心率不变

正确答案：B。降压

解析：在皮下注射治疗剂量的肾上腺素或低浓度静脉注射时，由于心脏兴奋，皮肤黏膜血管收缩，使收缩压和舒张压均升高。如果预先给α受体阻断药，如氯丙嗪，肾上腺素的升压作用可被翻转，呈现出明显的降压反应（B对），表现出肾上腺素β₂受体的激动作用。